能准确反映个体儿童生长匀称程度的评价方法是
A. 曲线图法
B. 相关回归法
C. 体型图法
D. 等级评价法
E. 年增加百分率

正确答案：B。相关回归法